2岁半至4岁期间的（牙合）特点是
A. 牙排列不紧密，前牙有间隙
B. 切缘及（牙合）面无显著磨耗
C. 上下颌第二乳磨牙的远中面不平齐
D. 上颌第二乳磨牙在下颌第二乳磨牙之后
E. 以上均不对

正确答案：B。切缘及（牙合）面无显著磨耗

解析：本题考查岁半至4岁期间的（牙合）特点。2岁半至4岁期间，乳牙列相邻牙排列紧密（A错），切缘及（牙合）面无显著磨耗（B对），上下颌第二乳磨牙的远中面常彼此相齐，成一垂直平面，称齐末平面（C错）。4岁至6岁期间，随着颌骨的生长发育，牙齿之间开始出现间隙，排列逐渐不紧密，上下颌第二乳磨牙的远中面不平齐，上颌第二乳磨牙在下颌第二乳磨牙之后（D错），牙的切缘及（牙合）面产生一定的磨耗。